医师在执业活动中不享有的权利是
A. 获得与本人执业活动相当的医疗设备，基本条件
B. 参加专业学术团体
C. 对病人进行无条件临床实验治疗
D. 在执业范围内进行疾病诊查和治疗
E. 接受继续医学教育和技能培训

正确答案：C。对病人进行无条件临床实验治疗

解析：对病人进行无条件临床实验治疗不属于医师在执业活动中享有的权利（C错，为本题正确答案）。